患者，男，60岁。腰胁部出现红色成簇丘疹、水疱3天，疼痛剧烈，舌红苔薄，脉弦数。应首先考虑的是
A. 瘾疹
B. 热疮
C. 丹毒
D. 药毒
E. 蛇串疮

正确答案：E。蛇串疮

解析：蛇串疮是一种皮肤上出现成簇水疱，多呈带状分布，痛如火燎的急性疱疹性皮肤病，相当于西医的带状疱疹，其特点是皮肤上出现红斑、水疱或丘疱疹，累累如串珠，排列成带状，沿一侧周围神经分布区出现，局部刺痛或伴臖核肿大，好发于成年人，老年人病情尤重，多发于胸胁部，本病例皮损特点与之相符，结合年龄及发病部位，故诊断蛇串疮（E对）。瘾疹，是一种皮肤出现红色或苍白色风团，时隐时现的瘙痒性、过敏性皮肤病，相当于西医的荨麻疹，其特点是皮肤上出现瘙痒性风团，发无定处，骤起骤退，退后不留痕迹，本病例皮损特点与之不符（A错）。热疮，是发热后或高热过程中在皮肤黏膜交界处所发生的急性疱疹性皮肤病，相当于西医的单纯疱疹，其特点是皮损为成群的水疱，有的相互融合，多在1周后痊愈，易于复发，本病例皮损特点有相似之处，但未提示患者有发热或高热病史，发病部位与之不符（B错）。丹毒，是患部皮肤突然发红成片、色如涂丹的急性感染性疾病，西医也称丹毒，临床特点为病起突然，恶寒发热，局部皮肤忽然变赤，色如丹涂脂染，焮热肿胀，边界清楚，迅速扩大，数日内可逐渐痊愈，但容易复发，本病例皮损特点与之不符（C错）。药毒，是指药物通过口服、注射或皮肤黏膜直接用药等途径，进入人体后所引起的皮肤或黏膜的急性炎症反应，相当于西医的药物性皮炎，其特点是发病前有用药史，并有一定的潜伏期，常突然发病，皮损形态多样，颜色鲜红，可泛发或仅限于局部，本病例未提示有特殊用药史，暂不考虑（D错）。